用于分析比较不同个体心功能的常用指标是
A. 每分输出量
B. 心指数
C. 射血分数
D. 心脏作功量
E. 心力贮备

正确答案：B。心指数